以下可影响唾液分泌的因素是
A. 年龄
B. 药物
C. 气候
D. 食物
E. 以上说法均正确

正确答案：E。以上说法均正确

解析：影响唾液分泌的因素很多，如情绪、气候、年龄、食物、药物、健康状况等。精神紧张、心理恐惧，会抑制唾液的分泌；季节寒冷，分泌量较多；气候炎热，由于出汗，唾液分泌量较少。美味食物、酸类食物能引起唾液分泌量增多；无味食物难以引起唾液分泌。药物如毛果芸香碱可促进唾液分泌；而阿托品则抑制唾液分泌。掌握“唾液的分泌和功能”知识点。